下列哪一项不是预防接种的异常反应
A. 过敏性休克
B. 变态反应性脑脊髓炎
C. 无菌性脓疡
D. 血清病
E. 接种部位24小时内炎症反应

正确答案：E。接种部位24小时内炎症反应

解析：本题考查预防接种的异常反应。异常反应是指合格的疫苗在实施规范接种过程中或者实施规范接种后造成受种者机体组织器官、功能损害，相关各方均无过错的药品不良反应。如过敏性休克（A对）、变态反应性脑脊髓炎（B对）、无菌性脓疡（C对）、血清病（D对）、过敏性紫癜、血小板减少性紫癜、局部过敏坏死反应等。接种部位24小时内炎症反应（E错，为本题正确答案）是预防接种的一般反应。